男，3岁，咳嗽间断发热半月，1月前患麻疹，预防接种不详，T37.6，P110，R22，双肺正常，P110，律齐，腹软，无压痛，胸部X线右上肺片状阴影，右肺门影增浓，边缘模糊，结核菌素48-72小时红肿10mm，硬结3mm。引起该症状的原因是
A. 接种卡介苗正常阳性
B. 结核菌素失效阴性
C. 未感染结核分枝杆菌呈阳性
D. 免疫抑制导致的假阴性
E. 感染结核阳性

正确答案：D。免疫抑制导致的假阴性

解析：阴性反应见于：①未感染过结核分枝杆菌②结核迟发型变态反应前期（初次感染后4-8周内）②假阴性反应（D对）：由于机体免疫功能低下或受抑制所致。